颈外动脉的终支是
A. 上颌动脉
B. 甲状腺上动脉
C. 面动脉
D. 舌动脉
E. 脑膜中动脉

正确答案：A。上颌动脉

解析：上颌动脉（A对）和颞浅动脉为颈外动脉在下颌颈处分开的两条终支。